治疗慢惊风脾虚肝亢证，应首选
A. 大定风珠
B. 十全大补汤
C. 缓肝理脾汤
D. 固真汤
E. 逐寒荡惊汤

正确答案：C。缓肝理脾汤

解析：大定风珠能育阴息风，为慢惊风阴虚风动证的选方（A错）。十全大补汤功能温补气血，主治气血两虚证（B错）。慢惊风脾虚肝亢证治宜温中健脾，缓肝理脾，方选缓肝理脾汤（C对）。固真汤与逐寒荡惊汤两方相合功能温补脾肾，回阳救逆，治疗慢惊风脾肾阳虚证（DE错）。